关节内骨折最常见的并发症是
A. 创伤性关节炎
B. 缺血性骨坏死
C. 骨化性肌炎
D. 骨筋膜室综合征
E. 骨折不愈合

正确答案：A。创伤性关节炎